坏死性涎腺化生的病理改变不包括
A. 腺小叶坏死
B. 上皮出现明显异形性
C. 上皮呈假上皮瘤样增生
D. 鳞状化生
E. 鳞状细胞团块

正确答案：B。上皮出现明显异形性

解析：坏死性涎腺化生的病理改变：溃疡周围的表面上皮呈假上皮瘤样增生，腺小叶坏死，腺泡壁溶解消失，粘液外溢形成粘液池。腺导管有明显的鳞状化生，形成大小不等的上皮岛或上皮条索。有的腺小叶完全被鳞状细胞团取代，易被误认为高分化的鳞状细胞癌或粘液表皮样癌。但化生的鳞状细胞形态较一致，无核异形性或间变。掌握“坏死性唾液腺化生与舍格伦综合征”知识点。